以下描述西地那非性质错误的是
A. 是5-磷酸二脂酶抑制剂
B. 用于治疗男性性功能障碍
C. 会产生面红，耳赤等反应
D. 禁与硝酸酯类物药合用
E. 可与NO供体类药物合用

正确答案：E。可与NO供体类药物合用

解析：本题考查西地那非的性质。西地那非通过减少cGMP的酶降解而发挥治疗勃起功能障碍的功效（B对），NO同样升高组织中cGMP的浓度，后者能够导致血管舒张，二者合用可显著降低血压引起心血管危险，因此不可与NO供体类药物合用（E错，为本题正确答案），也不能和硝酸酯类药物合用（D对）。西地那非属于5型磷酸二脂酶抑制剂（A对），可导致血管扩张或平滑肌松弛，所以易引起面红耳赤等不良反应（C对）。